下列各项中，不属于医学道德基本原则的是
A. 不伤害原则
B. 有利原则
C. 保密原则
D. 尊重原则
E. 公正原则

正确答案：C。保密原则

解析：本题考查医学道德的基本原则。医学道德基本原则的是尊重原则（D对）、不伤害原则（A对）、有利或有益原则（B对）、公正原则（E对），不包括保密原则（C错，为本题的正确答案） 。